牙周袋形成的机制是
A. 牙龈炎症引起的结合上皮根向增殖
B. 结缔组织中胶原纤维被大量破坏
C. 细菌及其产物引起牙龈炎症
D. 大量中性粒细胞侵入结合上皮并破坏其连接
E. 以上都是

正确答案：E。以上都是

解析：本题考查牙周袋形成的机制。牙周袋是病理性加深的龈沟，是牙周炎最重要的病理改变之一。牙龈边缘部的慢性炎症扩展到深部牙周支持组织，形成牙周炎。牙周袋形成的机制有大量中性粒细胞侵入结合上皮并破坏其连接（D对）结合上皮变得疏松；细菌及其产物侵入疏松地结合上皮引起牙龈炎症（C对），并侵入深层结缔组织引起结缔组织中胶原纤维被大量破坏（B对）；牙龈炎症引起的结合上皮根向增殖（A对），继而附着丧失，龈沟底加深牙龈与根面牙骨质分离，形成牙周袋。（ABCD均对，故E为本题的正确答案）。